一高中女生18岁，因乳房刺痛来医院就诊，诊室内除了一个女医生外还有一个男医学生，女医生未开口问诊，在让男医学生回避后才开始对患者问诊和查体。女医生让男医学生回避是实现了患者的
A. 尊重的需要
B. 安全的需要
C. 生理的需要
D. 社会交往的需要
E. 归属和爱的需要

正确答案：A。尊重的需要

解析：尊重患者的隐私，主要包括两方面内容：一是个人的私密性信息不被泄露，二是身体不被随意观察（A对）。